感染形成脓肿时面部肿胀明显，但脓肿难以自行溃破，不易发现波动感的间隙为
A. 咬肌间隙
B. 眶下间隙
C. 口底多间隙
D. 下颌下间隙
E. 颞间隙感染

正确答案：A。咬肌间隙

解析：本题考查间隙感染概述、眶下间隙、咬肌间隙感染。咬肌间隙（A对）感染的典型症状是以下颌支及下颌角为中心的咬肌区肿胀、充血、压痛，伴明显开口受限。由于咬肌肥厚坚实，脓肿难以自行溃破，也不易触到波动感。若炎症在一周以下，压痛点局限或有凹陷性水肿，经穿刺有脓液时，应行切开引流，否则由于长期脓液蓄积，易形成下颌骨升支部的边缘性骨髓炎。